最有可能引起副肿瘤综合征的肺癌类型是
A. 小细胞癌
B. 鱗状细胞癌
C. 腺鱗癌
D. 肉瘤样癌
E. 乳头状腺癌

正确答案：A。小细胞癌

解析：副肿瘤综合征多是由于神经内分泌型肺癌引起，尤其是小细胞肺癌（A对），分泌大量5-羟色胺而引起。鳞状细胞癌（B错）、腺鳞癌（C错）、肉瘤样癌（D错）、乳头状腺癌（E错）均非神经内分泌型肺癌。